《素问·调经论》说“血不足”，则
A. 怒
B. 喜
C. 思
D. 悲
E. 恐

正确答案：E。恐

解析：血有余则怒（A错），不足则恐（E对）。若出现气血不足，无以濡养魂魄，则发为恐。